结合自己的经验，并用概念的形式反映事物的特征为
A. 知觉的多维性
B. 知觉的整体性
C. 知觉的恒常性
D. 知觉的理解性
E. 知觉的选择性

正确答案：D。知觉的理解性

解析：知觉的基本特性包括选择性、整体性、理解性、恒常性。知觉的理解性（D对）是指人在感知当前的事物时，不仅依赖于当前的信息，还要根据自己过去的知识经验来理解它，给它赋予一定的意义。知觉的整体性（B错）是指知觉系统把感觉到客观事物的个别特征、个别属性整合为整体的功能的特性。知觉的恒常性（C错）当知觉对象的刺激输入在一定范围内发生了变化的时候，知觉形象并不因此发生相应的变化，而是维持恒定。知觉的选择性（E错）是个体根据自己的需要与兴趣，有目的地把某些刺激信息或刺激的某些方面作为知觉对象而把其他事物作为背景进行组织加工的过程。知觉不具有多维性（A错）。